胆囊动脉多直接发自
A. 睾丸动脉
B. 肝固有动脉
C. 肝左动脉
D. 肝右动脉
E. 脾动脉

正确答案：D。肝右动脉

解析：肝固有动脉入肝门前分为肝左支和肝右支分布于肝，肝右动脉（D对）直接发出胆囊动脉分布于胆囊。